患者女，经前或经期吐血衄血，量少色黯红，头晕耳鸣，手足心热，月经先期，量少，舌红少苔，脉细数。方选
A. 顺经汤
B. 两地汤
C. 清肝引经汤
D. 安冲汤
E. 固冲汤

正确答案：A。顺经汤

解析：患者素体肺肾阴虚，虚火上炎，经行后阴虚更甚，虚火内炽，损伤肺络，故血上溢而为吐衄；阴血虚则血量少，色红；虚火内盛，热伤胞络，故月经先期，量少；阴虚内热，故头晕耳鸣，手足心热；舌红少苔，脉细数，亦为阴虚内热之象；故辨证为经行吐衄之肺肾阴虚证，治宜滋阴养肺，方选顺经汤（A对）。两地汤主治月经先期、量少，属火热而水不足者（B错）。清肝引经汤主治肝经郁火之倒经、月经先期（C错）。安冲汤主治妇女经水行时多而且久，过期不止，或不时漏下（D错）。固冲汤主治脾肾虚弱，冲脉不固证（E错）。